某女，40岁，患痛风3年，最近2个月节食减肥体重快速下降，昨夜突发右脚趾关节疼痛，可能的原因是
A. 酮体抑制尿酸排泄
B. 乳酸抑制尿酸排泄
C. 脂肪酸抑制尿酸排泄
D. 草酸抑制尿酸排泄
E. 乙酸抑制尿酸排泄

正确答案：A。酮体抑制尿酸排泄

解析：本题考查该女士痛风发作可能的原因。本题中该女士患有痛风，其节食减肥体重快速下降，造成了能量不足，从而导致脂肪分解产生酮体等酸性代谢产物，抑制尿酸排泄（A对BCDE错），可能诱发痛风发作。